肺代偿调节
A. 固定酸
B. 挥发酸
C. 两者均有
D. 两者均无
E. 无

正确答案：B。挥发酸

解析：肺代偿调节挥发酸（B对）浓度，使血浆中 HC03-与H2C03 比值接近正常，以保持pH相对恒定。